多见于老年人，其病理表现为牙髓细胞减少，血管和神经消失，牙髓整体呈现纤维网状结构的为
A. 成牙本质细胞空泡变性
B. 牙髓钙化
C. 牙髓网状萎缩
D. 牙髓纤维变性
E. 牙髓坏死

正确答案：C。牙髓网状萎缩

解析：本题考查牙髓变性。多见于老年人，其病理表现为牙髓细胞减少，血管和神经消失，牙髓整体呈现纤维网状结构的为牙髓网状萎缩（C对）。牙髓网状萎缩多由于牙髓供血不足，出现大小不等的空泡状间隙，其中充满液体。牙髓细胞减少，成牙本质细胞、血管和神经消失，牙髓整体呈现纤维网状结构。